用匙形刮治器刮除龈下牙石时，工作面与牙面之间的角度应为
A. 30°
B. 80°
C. 90°
D. 110°
E. 120°

正确答案：B。80°

解析：刮治器在进入牙周袋，到达工作区域时的角度为0°，在工作时候，需要与牙面之间成一定角度才能发挥功能，进行刮治，此时工作面与牙面之间的角度应为80°。掌握“慢性牙周炎的治疗原则、程序及方法”知识点。